设备由2个或2个以上蒸发器串联面成人低能耗浓缩方法是
A. 减压浓缩
B. 多效浓缩
C. 常压浓缩
D. 降膜式薄膜浓缩
E. 离心式薄膜浓缩

正确答案：B。多效浓缩

解析：本题考查浓缩方法与设备。设备由2个或2个以上蒸发器串联面成人低能耗浓缩方法是多效浓缩（B对）。多效蒸发：系将两个或多个减压蒸发器并联形成的浓缩设备。减压蒸发：系指在密闭的容器内，抽真空降低内部压力，使料液的沸点降低而进行蒸发的方法，又称减压浓缩（A错）。常压蒸发：系指料液在一个大气压下进行蒸发的方法，又称常压浓缩（C错）。若待浓缩料液中的有效成分是耐热的，而溶剂又无燃烧性，无毒害者可用此法进行浓缩。薄膜蒸发：系指使料液在蒸发时形成薄膜，增加汽化表面积进行蒸发的方法，又称薄膜浓缩（D错）。薄膜蒸发的特点是蒸发速度快，受热时间短；不受料液静压和过热影响，成分不易被破坏；可在常压或减压下连续操作；能将溶剂回收重复利用。薄膜浓缩常用的设备有升膜式蒸发器、降膜式蒸发器、刮板式薄膜蒸发器、离心式薄膜蒸发器（E错）等。